某男，42岁。5年前诊断为糖尿病，经中西药治疗，病情得以控制。近日血糖有所升高，遂求中医诊治刻下多食善饥，每日需进食十余餐，餐后2小时左右便出现饥饿感，伴口渴多饮、乏力、小便频数而多、口苦咽干、舌质红、苔黄燥、脉细数。医生诊断为消渴病，证属阴虚火旺、津液被伤。处方：生石膏（先煎）30g，熟地黄10g，麦冬10g，知母10g，牛膝10g，柴胡5g，葛根10g，生甘草3g。方中葛根有效成分葛根素的结构类型是
A. 醌类
B. 强心苷类
C. 单萜类
D. 黄酮类
E. 甾体皂苷类

正确答案：D。黄酮类

解析：本题考查的是葛根的化学成分。葛根有效成分葛根素的结构类型是黄酮类（D对）。葛根含异黄酮类化合物，主要成分有大豆素、大豆苷、大豆素-7，4'-二葡萄糖苷及葛根素、葛根素-7-木糖苷。《中国药典》以葛根素为指标成分进行含量测定，要求含葛根素不得少于2.4%。醌类（A错）在许多常用中药中，如大黄、虎杖、丹参、紫草等存在此类化合物，其中许多有明显的生物活性。强心苷类（B错）强心苷是存在于生物界中的一类对心脏有显著生理活性的甾体苷类。主要分布于夹竹桃科、玄参科、百合科、萝藦科、十字花科、毛茛科和桑科等。动物中至今尚未发现强心苷成分，中药蟾酥是一类具有强心作用的甾体化合物，但不属于苷类，属于蟾毒配基的脂肪酸酯类。单萜类（C错）是指基本碳架由2分子异戊二烯单位构成，含有10个碳原子的萜烯及其衍生物。单萜类化合物是挥发油的主要组成成分之一（单萜苷类不具随水蒸气蒸馏的性质），常存在于菊科、唇形科、樟科、桃金娘科、芸香科、伞形科、姜科、松科等植物的腺体、油室及树脂道等分泌组织内。昆虫和微生物的代谢产物以及海洋生物中也含有单萜。单萜类化合物有玫瑰油、香叶天竺葵油、柠檬草油和香茅油等中的香叶醇（牻牛儿醇）；薄荷中的薄荷醇；冰片中的龙脑等。甾体皂苷类（E错）与三萜皂苷相似，由甾体皂苷元与糖组成。含甾体皂苷的常用中药主要有麦冬、知母等。